下列生活事件中，属于正性生活事件的是
A. 夫妻分居
B. 结婚
C. 坐牢
D. 子女离家
E. 改行

正确答案：B。结婚